国家对儿童实行预防接种证制度。在儿童出生及多长时间内，其监护人应为其办理预防接种证
A. 24小时内
B. 48小时内
C. 20天内
D. 1个月内
E. 2个月内

正确答案：D。1个月内